男，50岁。因持续心悸5天入院。既往体健，查体：BP142/80mmHg，心界不大，心率132次/分，心律不齐。心电图示：P波消失，代之以f波，心室律绝对不规则。控制心室率宜首选
A. 华法林
B. 腺苷
C. 胺碘酮
D. 比索洛尔
E. 普罗帕酮

正确答案：D。比索洛尔

解析：患者中年男性，持续心悸，心电图示：P波消失，代之以f波（房颤的典型波形），心室律绝对不规则（房颤的典型体征），考虑诊断为心房颤动。比索洛尔（D对）为选择性β₁受体拮抗剂，对心肌具有负性肌力、负性频率、负性传导的作用。故控制心室率宜首选比索洛尔。华法林（A错）可以抑制维生素K参与的凝血因子Ⅱ、Ⅶ、Ⅸ、Ⅹ在肝脏的合成，从而发挥抗凝作用，在房颤治疗中主要用于抗凝治疗，预防栓塞的形成。腺苷（P193）（B错）主要是激活与G蛋白偶联的钾通道，导致细胞膜超级化，动作电位时程缩短，可拮抗儿茶酚胺的作用，是治疗阵发性室上性心动过速的首选药物。胺碘酮为Ⅲ类抗心律失常药，在房颤治疗中主要用于转复并维持窦性心律，特别适用于合并器质性心脏病患者，但因副作用较多，目前被列为二线的抗心律失常药（C错）。普罗帕酮（P190）（E错）为ⅠC类抗心律失常药，在房颤治疗中也可用于转复并维持窦性心律，但其可能导致室性心律失常，不宜应用于严重器质性心脏病患者。本题正确答案为D。